液的作用重在
A. 润泽肌肤
B. 营养周身
C. 温煦内脏
D. 补益脑髓
E. 以上都不是

正确答案：D。补益脑髓

解析：液的质地较浓稠，渗入体内能濡养脏腑，渗注骨、脊、脑，能充养骨髓，脊髓、脑髓（D对），流入骨节，使关节滑利，屈伸自如。津的质地较清晰，布散于体表能滋润皮毛肌肉（A错）。营气的生理功能有化生血液和营养全身（B错）。温煦内脏（C错），为人体之气均有的功能。